下列哪种药不能用于有严重并发症的带状疱疹患者
A. 阿昔洛韦
B. 干扰素
C. 泼尼松
D. 西咪替丁
E. 转移因子

正确答案：C。泼尼松

解析：本题考查带状疱疹的治疗。泼尼松（C错，为本题正确答案）不能用于有严重并发症的带状疱疹患者。带状疱疹的治疗：①抗病毒药物，阿昔洛韦口服（A对）；②免疫调节药物，转移因子口服（E对），西咪替丁口服（D对）；③镇痛剂止痛；④神经营养药物维生素B₁、B₁₂；⑤糖皮质激素，只有病程在7天以内的健康老年患者可用泼尼松；⑥局部治疗；⑦中医中药治疗。